起效迅速且发挥全身作用的制剂是
A. 舌下片
B. 滴眼液
C. 漱口液
D. 滴耳液
E. 栓剂

正确答案：A。舌下片

解析：本题考查药物制剂。起效迅速且发挥全身作用的制剂是舌下片（A对）。舌下片系指置于舌下能迅速溶化，药物经舌下黏膜吸收而发挥全身作用的片剂；滴眼液（B错）为眼用制剂；漱口液（C错）用于口腔；滴耳液（D错）是供滴入外耳道用的液体制剂；栓剂（E错）系指药物与适宜基质制成的具有一定形状供腔道给药的固体外用制剂。